患者，女，25岁，两天前淋雨后开始发热，体温39.0°C，咳嗽，咳铁锈色黏痰，化验结果提示白细胞计数及中性粒细胞比例升高，诊断为肺炎，经验性抗感染治疗时适宜选用的药物
A. 阿奇霉素
B. 阿米卡星
C. 头孢他啶
D. 头孢唑林
E. 美罗培南

正确答案：D。头孢唑林

解析：本题考查头孢唑林。经验性抗感染治疗时适宜选用的药物是头孢唑林（D对）。社区获得性肺炎：青壮年和无基础疾病的CAP患者，常用第一代头孢菌素、青霉素类。对于耐药性肺炎链球菌可用对呼吸道感染有特效的氟喹诺酮类。阿奇霉素（A错）为大环内酯类抗生素，由于大环内酣类药物可致心血管不良事件（尤其是 Q-T 间期延长或既往心律失常的患者），同时我国肺炎链球菌及肺炎支原体对大环内酷类药物耐药率高，不建议单用大环内酯类药物。阿米卡星（B错）为氨基糖苷类抗生素，因其毒性大，不宜选用。头孢他啶（C错）是第三代头孢菌素类药物，用于老年人、有基础疾病或需要住院的患者治疗社区获得性肺炎。